一患者右下6缺失，右下5和右下7健康，缺隙正常。可摘局部义齿的支点线可以设计成
A. 斜线式
B. 直线式
C. 横线式
D. 纵线式
E. 平面式

正确答案：D。纵线式

解析：本题考查可摘局部义齿的Cummer分类。一患者右下6缺失，右下5和右下7健康，缺隙正常。可摘局部义齿的支点线可以设计成纵线式（D对）。可摘局部义齿的Cummer分类：第一类：支点线斜割牙弓，即斜线式（A错）。第二类：支点线横割牙弓，即横线式（C错）。第三类：支点线位于牙弓的一侧而呈前后方向者，即纵线式。第四类：支点线构成多边形，即平面式（E错）。